男，8个月。持续高热频咳，精神萎靡5天，近2天气促加重，今抽搐3次全身性发作嗜睡，查体：体温40℃，呼吸54次/分，心率148次/分，双肺少量湿啰音，左下肺闻及管状呼吸音，肝肋下1cm，白细胞计数明显升高。X线显示大小不等的片状病灶或融合性病灶，以两肺下野及右上肺多见。若患儿在病程中出规反复惊厥，腰椎穿刺颅压稍增高，脑脊液检查正常。最有可能的原因是
A. 中毒性脑病
B. 高热惊厥
C. 败血症
D. 心力衰竭
E. 癫痫

正确答案：A。中毒性脑病

解析：患儿反复惊厥，颅内压稍高，提示颅脑病变，但脑脊液检查正常，考虑中毒性脑病（A对）。高热惊厥（P400）（B错）无神经系统异常及颅内压升高。癫痫（P392）（E错）主要表现为肌强直、痉挛，惊厥程度较轻，表现为现为阵发性四肢和面部肌肉抽动，多伴有两侧眼球上翻、凝视或斜视。败血症（P128）（C错）脑脊液检查有细菌。心力衰竭（P316）（D错）反复惊厥很少见。